胸腺位于
A. 小部分位于上纵隔前份，大部分伸入前纵隔
B. 前纵膈
C. 颈根部
D. 上纵膈前份
E. 大部分位于上纵膈前份，小部分伸入前纵膈

正确答案：E。大部分位于上纵膈前份，小部分伸入前纵膈

解析：胸腺大部分位于上纵膈前份，小部分伸入前纵膈（E对），位于胸骨柄的后方，贴近心包上方和大血管前面。